下列有关唇在咀嚼中的作用相关叙述中，正确的是
A. 唇有丰富的感受器对温度和触压敏感
B. 上下唇闭合可防止食物或饮料从口腔溢出
C. 唇推送并保持食物在上下牙列间，以便对其切割
D. 唇帮助转运食物
E. 以上均正确

正确答案：E。以上均正确

解析：唇在咀嚼中的作用：唇有丰富的感受器对温度和触压敏感，可防止不适宜的食物进入口腔。唇推送并保持食物在上下牙列间，以便对其切割；唇帮助转运食物。上下唇闭合可防止食物或饮料从口腔溢出。掌握“牙动度和唇、舌、腭对咀嚼的作用”知识点。